甘蔗节菱孢霉产生的3-硝基丙酸主要损害
A. 消化系统
B. 周围神经系统
C. 中枢神经系统
D. 呼吸系统
E. 内分泌系统

正确答案：C。中枢神经系统